女，22岁，突发腹痛12小时。腹痛呈持续性，先以脐部为主，后固定于右下腹，逐渐加重，伴恶心，无呕吐。查体：T37.5℃，P100次／分，R22次／分，BP110/70mmHg。痛苦面容，双肺未闻及啰音，心律齐。腹软，右下腹压痛，无反跳痛，Murphy征阴性，肝脾肋下未触及，肠鸣音减弱。血常规：Hb120g/L，WBC13×10⁹/L，N0.85，Plt200×10⁹/L。拟行手术治疗。如腰大肌试验阳性，则术中阑尾最可能的位置是
A. 盆位
B. 回肠前位
C. 盲肠后位
D. 盲肠下位
E. 回肠后位

正确答案：C。盲肠后位

解析：青年女性患者，突发腹痛12小时。腹痛呈持续性，先以脐部为主，后固定于右下腹（转移性右下腹疼痛为急性阑尾炎的典型表现），逐渐加重，伴恶心，无呕吐。查体：T37.5℃（正常值36.0℃～37.0℃），P100次／分，R22次／分，BP110/70mmHg。痛苦面容，双肺未闻及啰音，心律齐。腹软，右下腹压痛，无反跳痛，Murphy征阴性，肝脾肋下未触及，肠鸣音减弱。血常规：Hb120g/L，WBC13×10⁹/L（（4～10）×10⁹/L），N0.85（正常值0.50～0.75），Plt200×10⁹/L（100～300×10⁹/L）。结合患者症状、体征和影像学检查，该患者最可能的诊断是急性阑尾炎，如腰大肌试验阳性，则术中阑尾最可能的位置是盲肠后位（C对）。阑尾尖端指向有回肠前位、盆位、盲肠后位、盲肠下位、盲肠外侧位和回肠后位六种类型。腰大肌试验阳性时，提示阑尾炎位置较深或在盲肠后位靠近腰大肌处，或炎症已波及腰大肌。闭孔内肌试验阳性即病人仰卧，右髋和右大腿屈曲，被动内旋时右下腹疼痛，提示阑尾的位置是盆位（A错）。而阑尾位于盲肠下位（D错）、回肠前位（B错）和回肠后位（E错）时，较难通过辅助试验判断阑尾的位置。